手-足-口病的致病病毒是
A. 柯萨奇病毒A17或EV61
B. 柯萨奇病毒A17或EV71
C. 柯萨奇病毒A16或EV61
D. 柯萨奇病毒A16或EV71
E. 柯萨奇病毒A61或EV17

正确答案：D。柯萨奇病毒A16或EV71

解析：手-足-口病：是因感染柯萨奇病毒A16或EV71型所引起的皮肤黏膜病。掌握“手-足-口病”知识点。